关于疣状白斑下列哪项说法是错误的
A. 表面有毛刺状突起
B. 表面高低不平
C. 与烟酒刺激无关
D. 有明显的局部刺激因素
E. 基底无明显硬结

正确答案：C。与烟酒刺激无关

解析：口腔白斑的病损的发病因素与吸烟、饮酒、嚼槟榔等行为有关。疣状型：损害隆起，表面高低不平，伴有乳头状或毛刺状突起，触诊微硬。除位于牙龈或上腭外，基底无明显硬结，损害区粗糙感明显。掌握“口腔白斑病”知识点。